下述自身免疫性疾病的特点除外的是
A. 体内可检测到针对自身抗原的自身反应性T淋巴细胞
B. 易反复发作
C. 病情的转归与自身免疫反应强度密切相关
D. 迁延较快
E. 自身抗体介导对自身细胞的适应性免疫应答，造成损伤或功能障碍

正确答案：D。迁延较快

解析：自身免疫性疾病有下述特点：①患者体内可检测到针对自身抗原的自身抗体和（或）自身反应性T淋巴细胞；②自身抗体和（或）自身反应性T淋巴细胞介导对自身细胞或自身成分的适应性免疫应答，造成损伤或功能障碍；③病情的转归与自身免疫反应强度密切相关；④易反复发作，慢性迁延。掌握“自身免疫概述以及临床常见自身免疫性疾病”知识点。